咬合创伤导致患牙牙髓坏死的因素是
A. 物理因素
B. 化学因素
C. 局部感染
D. 免疫作用
E. 病灶感染

正确答案：A。物理因素

解析：本题考查咬合创伤导致患牙牙髓坏死的因素。物理因素（A对）包括：创伤、温度、电流、激光等。化学因素（B错）包括：充填材料、酸蚀剂和粘接剂、消毒药物等。口腔非特异性免疫成分除黏膜屏障外（D错），主要是唾液中的一些抗菌蛋白。龋病、牙周病等局部感染病灶（CE错），可引起牙髓炎症，最终可导致牙髓坏死。